根据《药品经营质量管理规范》，药品经营企业对首营企业和首营品种应分别审核其
A. 招标采购能力和药品质量
B. 合法资格和药品价格
C. 合法资格和是否是基本药物
D. 合法资格和药品质量
E. 供货能力和药品质量

正确答案：D。合法资格和药品质量

解析：本题考查的是首营企业与首营品种的审核。根据《药品经营质量管理规范》，药品经营企业对首营企业和首营品种应分别审核其合法资格和药品质量（D对）。首营企业与首营品种的审核：对于首营企业与品种，采购部门应当填写相关申请表格，经过质量管理部门和企业质量负责人的审核批准。必要时应当组织实地考察，对供货单位质量管理体系进行评价。对首营企业的审核，应当查验加盖其公章原印章的以下资料，确认真实、有效：《药品生产许可证》或者《药品经营许可证》复印件；营业执照、税务登记、组织机构代码的证件复印件，以及上一年度企业年度报告公示情况；相关印章、随货同行单（票）样式；开户户名、开户银行及账号。采购首营品种应当审核药品的合法性，索取加盖供货单位公章原印章的药品生产或者进口批准证明文件复印件并予以审核，审核无误的方可采购。以上资料应当归入药品质量档案。